男，19岁，大学一年级学生，自述上大学2个月以来，每天过的都很压抑，思念乡里的家人，不能与同学打成一片，郁郁寡欢，晚上常独自流泪，但能坚持上课，有强烈的退学回家念想，否认自杀企图或悲观厌世的想法，该患者最有可能的诊断是
A. 焦虑障碍
B. 强迫障碍
C. 急性应激障碍
D. 抑郁发作
E. 适应障碍

正确答案：E。适应障碍

解析：大学一年级学生，上大学2个月以来（时间短，生活环境改变的诱因），压抑、思念家人，表现为适应不良，症状较轻，最有可能的诊断是适应障碍（E对）。无自杀企图或悲观厌世的想法（抑郁发作的可能性小）（D错）。焦虑障碍（A错）的主要特点是“害怕、恐惧，担心”。强迫障碍（B错）患者常出现强迫观念、冲动或行为，且多数患者认为这些观念和行为没有必要或不正常，违反了自己的意愿，无法摆脱，为此感到焦虑和痛苦（P142）。急性应激障碍（C错）患者多表现为分离性遗忘，即应激事件后迅速出现的，仅与事件相关内容有关的遗忘（P157）。